切断脊髓侧索，可导致切断部位以下
A. 同侧随意运动丧失
B. 同侧随意运动及深、浅部感觉丧失
C. 同侧腱反射消失，触觉和压觉丧失
D. 同侧随意运动丧失及对侧痛、温度觉障碍
E. 同侧痛、温度觉全部丧失

正确答案：D。同侧随意运动丧失及对侧痛、温度觉障碍

解析：脊髓侧束主要传导同侧躯干（除颈部外）和下肢的本体感觉，切断脊髓侧索，可导致切断部位以下同侧随意运动丧失及对侧痛、温度觉障碍（D对）。